“中焦如沤”是比喻
A. 胃主受纳的功能状态
B. 脾气散精的功能状态
C. 小肠泌别清浊的功能状态
D. 水谷精微的弥漫布散状态
E. 消化过程中腐熟水谷的状态

正确答案：E。消化过程中腐熟水谷的状态

解析：“中焦如沤”是对脾胃、肝胆等脏腑的消化饮食物的作用形象化的描写与概括，喻指中焦消化饮食物的作用，如发酵酿造之过程（E对）。“上焦如雾”是对心肺输布营养至全身的作用形象化的描写与概括，喻指上焦宣发卫气，敷布水谷精微、血和津液的作用，如雾露之灌溉（D错）。“下焦如渎”是对大肠、肾和膀胱排泄糟粕和尿液的作用和形式的描写与概括，喻指肾、膀胱、大肠等脏腑排泄二便的功能，如沟渠之通导。